手淫的危害不包括
A. 男孩频繁手淫易造成频繁遗精
B. 女孩月经失调、痛经
C. 阴道内细菌感染
D. 大脑过度兴奋而引起神经衰弱
E. 内分泌紊乱

正确答案：E。内分泌紊乱

解析：本题考查手淫的危害。内分泌紊乱（E错，为本题正确答案）主要是由激素产生过多、激素产生过少和激素在靶组织抵抗这三大类原因导致。手淫的危害会因大脑过度兴奋而引起神经衰弱（D对）；男孩频繁手淫易造成频繁遗精（A对）；女孩手淫会引起月经失调、痛经（B对），造成阴道内细菌感染（C对）。